不属于风湿热诊断标准中主要表现的
A. 关节痛
B. 舞蹈病
C. 皮下小结
D. 环形红斑
E. 心脏炎

正确答案：A。关节痛

解析：风湿热诊断标准（Jones（1992年）AHA修订标准]中主要表现包括心脏炎（E对）、多关节炎、舞蹈病（B对）、环形红斑（D对）、皮下结节（C对）。次要表现包括：关节痛（A错，为本题正确答案）、发热、急性反应物（ESR，CRP）增高、心电图P-R间期延长。